关于皂苷性质的说法，正确的有
A. 气味芳香
B. 易溶于水
C. 对黏膜有强烈的刺激性
D. 多数具有苦而辛辣味
E. 水溶液强烈震荡产生持久性泡沫

正确答案：B、C、D、E。易溶于水；对黏膜有强烈的刺激性；多数具有苦而辛辣味；水溶液强烈震荡产生持久性泡沫

解析：本题考查的是皂苷的理化性质。关于皂苷性质的说法，正确的有易溶于水（B对）、对黏膜有强烈的刺激性（C对）、多数具有苦而辛辣味（D对）与水溶液强烈震荡产生持久性泡沫（E对）。皂苷的理化性质：1.性状：（1）皂苷分子量较大，不易结晶，大多为无色或乳白色无定型粉末。（2）皂苷多数具有苦而辛辣味，其粉末对人体黏膜有强烈的刺激性，鼻内黏膜尤其敏感。（3）皂苷大多具有吸湿性，应干燥保存。（4）多数三萜皂苷都呈酸性。2.溶解度：大多数皂苷极性较大，易溶于水、热甲醇和乙醇等极性较大的溶剂，难溶于丙酮、乙醚等有机溶剂。3.发泡性：皂苷水溶液经强烈振荡能产生持久性的泡沫，且不因加热而消失。4.溶血性：皂苷的水溶液大多能破坏红细胞，产生溶血现象。5.熔点与旋光度：皂苷常在熔融前就已经分解，因此无明显的熔点，一般测的都是分解点。测定旋光度对判断皂苷的结构有重要意义。6.皂苷的水解：皂苷苷键的裂解，通常可采用一般苷类化合物苷键裂解的方法，如酸催化水解、氧化水解和酶解等。7.显色反应：皂苷通常应用的显色反应有Liebermann反应、醋酐-浓硫酸反应、三氯乙酸反应、五氯化锑反应及芳香醛-硫酸或高氯酸反应。